与视觉传导通路无关的结构是
A. 视交叉
B. 内侧膝状体
C. 外侧膝状体
D. 视束
E. 视辐射

正确答案：B。内侧膝状体

解析：视觉传导通路由三级神经元组成。第一级神经元为视网膜内的双极细胞。第二级神经元为视网膜内的节细胞，由节细胞发出的轴突形成视神经，经视神经管进入颅腔。在视交叉处（A对），来自两眼视网膜颞侧半的纤维左右交叉，两眼鼻侧半交叉后的纤维和颞侧半不交叉的纤维形成左、右视束（D对），止于第三级神经元即外侧膝状体（C对）。然后发出纤维组成视辐射（E对），经内囊后肢投射至距状沟周围皮质。内侧膝状体（B错，为本题正确选项）为听觉传导纤维。